男，40岁。从三楼跌下，左6、7、8肋骨骨折，脾破裂、肠破裂。入院时精神紧张，T38.5度，面色苍白肢端冰冷，脉搏细速，P110次/分，血压130/100mmHg，尿量减少。该病人的状态应属于
A. 暖休克
B. 冷休克
C. 休克前期
D. 中度休克
E. 重度休克

正确答案：C。休克前期

解析：患者高空坠落导致肋骨骨折、脾破裂、肠破裂，出现精神紧张、面色苍白、肢端冰冷、脉搏细速、尿量减少等表现，提示出现失血性休克。患者P110次/分，血压130/100mmHg，提示患者处于轻度休克，即休克前期（C对DE错）。休克前期患者表现为脉率100次/分以下，收缩压正常或升高，舒张压增高；中度休克表现为脉率100～200次/分，收缩压90mmHg～70mmHg；重度休克表现为脉细速或摸不清，收缩压＜70mmHg或测不到。详见表5-1 休克的临床表现和程度（P30）。需注意：若经脉搏、收缩压判断出的休克分期矛盾，应以收缩压为准。而暖休克（A错）、冷休克（B错）属于感染性休克的分类标准，而非失血性休克的分类标准。